在一所医院的300名吸烟男医师中，有100人自动戒烟，200人继续吸烟，研究者进行了20年的随访观察，以确定两组肺癌的发生与死亡情况，这种研究属于
A. 实验研究
B. 病例对照研究
C. 描述性研究
D. 队列研究
E. 理论性研究

正确答案：D。队列研究